依据《中华人民共和国药品管理法实施条例》的规定，对已经批准生产、销售的药品进行再评价的部门是
A. 所在地县（市）级药品监督管理机构
B. 所在地省级药品监督管理部门
C. 国务院药品监督管理部门
D. 所在地省级卫生行政部门
E. 所在地县级卫生行政部门

正确答案：C。国务院药品监督管理部门

解析：本题考查再评价。《中华人民共和国药品管理法实施条例》第四十条：国务院药品监督管理部门（C对）对已批准生产、销售的药品进行再评价，根据药品再评价结果，可以采取责令修改药品说明书，暂停生产、销售和使用的措施；对不良反应大或者其他原因危害人体健康的药品，应当撤销该药品批准证明文件。